虫体似蚕，外表深黄色至黄棕色，有20～30条环纹，子座深棕色至棕褐色，上部稍膨大的是
A. 蛹草
B. 草石蚕
C. 凉山虫草
D. 冬虫夏草
E. 亚香棒虫草

正确答案：D。冬虫夏草

解析：本题考查的是冬虫夏草药材的性状鉴别。虫体似蚕，外表深黄色至黄棕色，有20～30条环纹，子座深棕色至棕褐色，上部稍膨大的是冬虫夏草（D对）。冬虫夏草：【性状鉴别】药材由虫体与从虫体头部长出的真菌子座相连而成。虫体似蚕；表面深黄色至黄棕色，有20～30条环纹，近头部环纹较细；头部红棕色；足8对，中部4对较明显；质脆，易折断，断面略平坦，淡黄白色。子座细长圆柱形；表面深棕色至棕褐色，有细纵皱纹，上部稍膨大；质柔韧，断面类白色。气微腥，味微苦。蛹草（A错）、草石蚕（B错）、凉山虫草（C错）与亚香棒虫草（E错）的性状鉴别，2022年考试指南未明确说明。